某男，因工作压力，思虑过多，经常寐而易醒，伴心悸健忘，面色无华，易汗出，纳差倦怠，舌淡,脉细弱。针灸治疗除照海、申脉、神门、印堂、四神聪、安眠外，应加取
A. 行间、侠溪、肝俞
B. 心俞、脾俞、足三里
C. 丘墟、心俞、内关
D. 太溪、心俞、肾俞
E. 公孙、内关、足三里

正确答案：B。心俞、脾俞、足三里

解析：题干中患者经常寐而易醒，为不寐，因工作压力，思虑过多，伴心悸健忘为心气虚的表现，面色无华，易汗出，纳差倦怠，舌淡,脉细弱为脾气虚的表现，不寐的心脾两虚证加心俞、脾俞（B对）。行间、侠溪治疗肝火扰心的不寐（A错）。丘墟、内关不是治疗不寐的常用穴位（C错）。太溪、心俞、肾俞治疗心肾不交的不寐（D错）。公孙、内关、足三里治疗脾胃不和的不寐（E错）。